对十二指肠溃疡急性穿孔的描述，错误的是
A. 部分患者既往无溃疡病症状
B. 男性发生率高于女
C. 穿孔部位最多见于球部前壁
D. 明确诊断后，均应行急症手术治疗
E. 大部分腹部X线平片可见膈下游离气体

正确答案：D。明确诊断后，均应行急症手术治疗

解析：急性穿孔是十二指肠溃疡常见的并发症。大部分十二指肠溃疡穿孔需急症手术治疗，但对于一般情况良好、无弥漫性腹膜炎的空腹穿孔患者，可行非手术治疗（D错，为本题正确答案）。十二指肠溃疡急性穿孔患者大多有溃疡病史，但部分患者既往无溃疡病症状（A对），其男性发生率高于女性（B对），穿孔部位最多见于十二指肠前壁（C对）。穿孔后由于肠道内气体进入腹腔，立位时气体积聚于膈下，因此大部分患者立位腹部X线平片可见膈下游离气体（E对）。